医学伦理学的研究对象，除外以下
A. 医际之间的关系
B. 医务人员和社会的关系
C. 政府行政部门之间的关系
D. 医务人员和医学科学发展之间的关系
E. 医务人员和病人的关系

正确答案：C。政府行政部门之间的关系